第一躯体运动区的说法，错误的是
A. 于中央前回和中央旁小叶前部
B. 下肢的投影区是中央前回最上部和中央旁小叶前部
C. 头部在该部的投影是中央前回的下部，但头部是正的
D. 发出纤维构成锥体束，支配对侧半的骨骼肌作随意运动
E. 一侧运动区受损，躯干对侧半及对侧上、下肢体的骨骼肌瘫痪

正确答案：E。一侧运动区受损，躯干对侧半及对侧上、下肢体的骨骼肌瘫痪

解析：第一躯体运动区位于中央前回和中央旁小叶前部（A对），上下颠倒，但头部是正的，头部在该部的投影是中央前回的下部（C对），中央前回最上部和中央旁小叶前部与下肢、会阴部运动有关（B对），发出纤维构成锥体束，支配对侧半的骨骼肌作随意运动（D对），一侧运动区支配对侧肢体的运动。但一些与联合运动有关的肌则受两侧运动区的支配（E错，为本题正确选项）。